五味子的功效有
A. 敛肺
B. 敛汗
C. 止泻
D. 止血
E. 止带

正确答案：A、B、C。敛肺；敛汗；止泻

解析：本题考查的是五味子的性能特点。五味子的功效有敛肺（A对）、敛汗（B对）与止泻（C对）。五味子：【性能特点】本品酸敛质润温补，敛、补兼备，入肺、肾、心经。上能敛肺止咳平喘，下能滋肾涩精止泻，内能生津宁心安神，外能固表收敛止汗。五味俱备，唯酸独胜；虽曰性温，但质滋润；敛补相兼，节流增源。药力较强，为补虚强壮收涩之要药。椿皮：【功效】清热燥湿，涩肠，止血（D错），止带（E错），杀虫。